白假丝酵母菌用的抗生素
A. 甲硝唑
B. 克霉唑
C. 酮康唑
D. 青霉素
E. 阿奇霉素

正确答案：B。克霉唑

解析：白假丝酵母菌又称为白色念珠菌，可引起皮肤、口腔、黏膜和内脏的急、慢性感染，即假丝酵母菌病，常用克霉唑治疗（B对）。